男，67岁。慢性咳喘20年，间断性下肢水肿3年。查体：BP120/80mmHg，颈静脉怒张，左下肺可闻及干湿啰音，心界向左扩大，P₂＞A₂，三尖瓣区可闻及3/6级杂音。肝肋下3cm。该患者最可能的诊断是：
A. 肥厚型心肌病
B. 风湿性心脏瓣膜病
C. 冠心病
D. 慢性肺源性心脏病
E. 急性心肌炎

正确答案：D。慢性肺源性心脏病

解析：患者为老年男性，慢性咳喘20年（为慢阻肺的典型表现），首先考虑为慢阻肺。患者颈静脉怒张，心界向左扩大，肝肋下3cm（为右心衰竭的表现），P₂＞A₂，三尖瓣区可闻及3/6级杂音（为肺动脉高压的表现），考虑是慢性肺源性心脏病（D对）（慢阻肺为慢性肺源性心脏病最常见的原因，且患者有慢性肺源性心脏病的典型表现及体征）。肥厚型心肌病（A错）（P266）常见劳力性呼吸困难和乏力，可在3、4肋间闻及收缩期杂音，但较少出现干湿性啰音及P₂＞A₂的体征，所以不作为首选诊断。风湿性心瓣膜病（B错）（P285）好发于二尖瓣及主动脉瓣，常出现二尖瓣及主动脉瓣区的杂音，本患者未明确表明有这类杂音，且该患者没有风湿病史，故不作为首选诊断。冠心病（C错）（P229）的典型症状为阵发性胸前区疼痛或憋闷，休息或服用硝酸甘油后疼痛消失，与本患者症状不符，故不考虑。急性心肌炎（E错）（P270）发病前1-3周常有病毒感染前驱症状，大多数是以心律失常为主诉或首见症状，患者未出现这些症状，故不作为首选诊断。